左侧继发性三叉神经痛，除出现左面部痛觉减退外，尚有的体征为
A. 左角膜反射消失，下颌向右偏斜
B. 左角膜反射存在，下颌向右偏斜
C. 左角膜反射消失，下颌无偏斜
D. 左角膜反射消失，下颌向左偏斜
E. 左角膜反射存在，下颌无偏斜

正确答案：D。左角膜反射消失，下颌向左偏斜

解析：三叉神经共有三个分支，从上到下分别为眼神经支、上颌神经支和下颌神经，其中眼神经支与角膜反射有关，如三叉神经痛为眼神经病变，可合并同侧角膜反射减弱和消失。下颌支支配翼内肌、翼外肌等咀嚼肌，如为下颌神经病变可合并同侧咀嚼肌无力，张口时下颌向患侧偏斜。故左侧继发性三叉神经痛，除出现左面部痛觉减退外，尚有的体征为左角膜反射消失，下颌向左偏斜（D对）。